综合考虑相对危险度及人群暴露率两因素来探讨暴露因素对目标人群的影响，具有公共卫生学意义的指标为
A. 相对危险度
B. 归因危险度
C. 归因危险度百分比
D. 发病密度
E. 人群归因危险度百分比

正确答案：E。人群归因危险度百分比

解析：本题考查人群归因危险度百分比。人群归因危险度百分比（E对ABCD错）是指总人群发病率中归因于暴露的部分占总人群全部发病或死亡的百分比。它是通过比较全人群与对照组的率算出的，说明暴露对全人群的危害程度，以及消除这个因素后该人群中的发病率或死亡率可能降低的程度，具有公共卫生学意义。